影响药物吸收的因素是
A. 首过效应
B. 与血浆蛋白结合
C. 血脑屏障
D. 胎盘屏障
E. 肝脏代谢

正确答案：A。首过效应

解析：影响药物吸收的因素是首过效应（A对）。首过效应（八版药理学P7）又称之为首关代谢或首关效应，从胃肠道吸收入门静脉系统的药物在到达全身血液循环前必先通过肝脏，如果肝脏对其代谢能力很强，或由胆汁排泄的量大，则进入全身血液循环内的有效药量明显减少，这种作用称为首过效应。与血浆蛋白结合（B错）是很多药物在血液中的存在形式，药物与血浆蛋白结合后，可以使药物分子变大，不利于其转运。血脑屏障（C错）是脑组织内的毛细血管内皮细胞等组成的血液与脑脊液之间的屏障；胎盘屏障（D错）是胎盘绒毛与子宫血窦之间的屏障。两者影响药物的分布。肝脏代谢（E错）是药物常见的代谢方式。